下面关于“生长长期变化”的描述，哪个是错误的
A. 生长长期变化既可表现为正向增长，又可表现为停滞增长
B. 生长长期变化没有明确的方向
C. 我国儿童青少年生长长期变化的现象很明显
D. 生长长期变化有一定的限度
E. 生长长期变化是社会多种因素作用的结果

正确答案：B。生长长期变化没有明确的方向